中间综合征常发生在有机磷中毒后
A. 4～12小时
B. 24～96小时
C. 7～9天
D. 12～24天
E. 30～60天

正确答案：B。24～96小时